下列有关翼腭间隙的描述，哪一项是错误的
A. 前界上颌骨体
B. 后界蝶骨翼突
C. 上界蝶骨大翼
D. 内界为腭骨垂直板
E. 位于颞下窝下方

正确答案：E。位于颞下窝下方

解析：本题考查翼腭窝。下列有关翼腭间隙的描述错误的是位于颞下窝下方（E错，为本题的正确答案）。翼腭间隙位于颞下窝的内侧，其前界为上颌骨体（A对），后界为蝶骨翼突（B对），上界为蝶骨大翼（C对），内界为腭骨垂直板（D对）。